某男，20岁。患风热咳嗽、痰多上气。宜选用的中成药是
A. 强力枇杷露
B. 川贝止咳露
C. 清肺抑火丸
D. 蛇胆川贝散
E. 降气定喘丸

正确答案：B。川贝止咳露

解析：本题考查川贝止咳露的主治。宜选用的中成药是川贝止咳露（B对）。川贝止咳露【主治】风热咳嗽，痰多上气或燥咳。强力枇杷露（A错）（胶囊）【主治】痰热伤肺所致的咳嗽经久不愈、痰少而黄或干咳无痰；急、慢性支气管炎见上述证候者。清肺抑火丸（C错）【主治】痰热阻肺所致的咳嗽、痰黄黏稠、口干咽痛、大便干燥。蛇胆川贝散（D错）（胶囊、软胶囊）【主治】肺热咳嗽，痰多。降气定喘丸（E错）【主治】痰浊阻肺所致的咳嗽痰多，气逆喘促；慢性支气管炎、支气管哮喘见上述证候者。